地西泮的不良反应有
A. 嗜睡、头昏、乏力
B. 大剂量可产生共济失调
C. 长期应用可产生耐受性、依赖性
D. 帕金森综合征
E. 凝血机制障碍

正确答案：A、B、C。嗜睡、头昏、乏力；大剂量可产生共济失调；长期应用可产生耐受性、依赖性

解析：本题考查地西泮。地西泮不良反应有嗜睡、头昏、乏力等（A对）；大剂量可产生共济失调（C对）；长期用药可产生耐受性、依赖性（B对）；帕金森综合征（D错）可能由神经安定剂（吩噻嗪类和丁酰苯类）导致；凝血机制障碍（E错）由维生素K缺乏症、血友病引发。